一开放性外伤患者，急需注射破伤风抗毒素血清，皮试发现过敏，需采用的主要防治措施是
A. 色甘酸二钠阻止肥大细胞脱颗粒
B. 生物活性介质拮抗剂——苯海拉明
C. 肾上腺素
D. 异种免疫血清脱敏疗法
E. 特异性变应原脱敏疗法

正确答案：D。异种免疫血清脱敏疗法